患者。男，32岁，右上后牙持续胀痛不能咬物，无冷热刺激痛病史。检查发现右上第二磨牙远中牙龈红肿，探诊出血。第三磨牙伸长无对颌牙。最佳治疗方案
A. 切开引流，局部冲洗上药，急性炎症消退后牙周治疗
B. 彻底清洁局部，冲洗上药
C. 彻底清洁局部，冲洗上药，调整咬合
D. 彻底清洁局部，冲洗上药，炎症消退后拔除第三磨牙
E. 彻底清洁局部，冲洗上药，及时修复对颌牙

正确答案：D。彻底清洁局部，冲洗上药，炎症消退后拔除第三磨牙

解析：本题考查急性龈乳头炎的治疗。患者。男，右上后牙持续胀痛不能咬物（有胀痛），无冷热刺激痛病史（无牙髓炎）。检查发现右上第二磨牙远中牙龈红肿，探诊出血，第三磨牙伸长无对颌牙（第三磨牙无咬合），综合考虑初步诊断为急性龈乳头炎（A错）。病因可能是右侧上颌第三磨牙萌出，与右上第二磨牙远中有食物嵌塞，最佳治疗方案是彻底清洁局部，冲洗上药，炎症消退后拔除第三磨牙（D对）。急性龈乳头炎的治疗：1.去除局部刺激因素；2.消除急性炎症；3.局部使用抗菌消炎药物；4.彻底去除病因。由于第三磨牙伸长无对颌牙，故不用调整咬合（C错）或者修复对颌牙（E错）。本病例病因为右侧上颌第三磨牙萌出，与右上第二磨牙远中有食物嵌塞，应针对病因进行处理，且第三磨牙无咬合，不能仅仅是清洁局部，冲洗上药（B错），还需炎症消退后拔除第三磨牙。